以下药物的鉴别反应是：黄体酮
A. 加热的碱性酒石酸铜试液，生成红色沉淀
B. 加乙醇制氢氧化钾溶液，加热水解后，测定析出物的熔点，应为150℃～156℃
C. 加亚硝基铁氰化钠细粉、碳酸钠及醋酸铵，显蓝紫色
D. 加硝酸银试液，生成白色沉淀
E. 与茚三酮试液反应，显蓝紫色

正确答案：C。加亚硝基铁氰化钠细粉、碳酸钠及醋酸铵，显蓝紫色